女，40岁。颞侧搏动样头痛，伴恶心、呕吐、怕光，持续1～2天。发作前有视物变形和亮点。有头痛发作史20年。查体无异常。头痛发作时口服药物治疗不宜选择
A. 吲哚美辛
B. 尼莫地平
C. 麦角胺咖啡因
D. 英明格
E. 甲灭酸

正确答案：B。尼莫地平

解析：患者中年女性，颞侧搏动样头痛，伴恶心呕吐怕光，持续1～2天，发作前有视物变形和亮点（视觉先兆），有头痛发作史20年。应诊断为有先兆偏头痛。偏头痛的药物治疗分为发作期治疗和预防性治疗。预防性治疗药物包括β肾上腺素能受体阻滞剂、钙离子拮抗剂、抗癫痫药、抗抑郁药和5-HT受体拮抗剂。发作期治疗药物包括非甾体类抗炎药等非特异性药物和麦角类、曲普坦类等阿片类特异性药物（P162）。吲哚美辛（A对）、甲灭酸（E对）均为非甾体类抗炎药。麦角胺咖啡因（C对）和英明格（D对）分别为麦角类和曲普坦类特异性阿片类药物。尼莫地平（B错，为本题正确答案）为二氢吡啶类钙离子拮抗剂，用于偏头痛的预防性治疗。